痣样基底细胞癌综合征的表现中，不包括
A. 多发性角化囊肿
B. 皮肤基底细胞痣
C. 易伴发成釉细胞瘤
D. 大脑廉钙化
E. 分叉肋

正确答案：C。易伴发成釉细胞瘤

解析：本题考查痣样基底细胞癌综合征的表现。痣样基底细胞癌综合征的表现中不包括易伴发成釉细胞瘤（C错，为本题的正确答案）。多发性角化囊性瘤同时伴有皮肤基底细胞痣，称为痣样基底细胞癌综合征，表现复杂，可累及多种组织或器官，其症状群主要包括多发性角化囊肿（A对）、皮肤基底细胞痣（B对）、大脑廉钙化（D对）、分叉肋（E对）、眶距增宽、颅骨异常等症状，不包括成釉细胞瘤。